能合成脂肪，但不能储存脂肪的是
A. 肝细胞
B. 脂肪组织
C. 小肠
D. 肾脏
E. 胆囊

正确答案：A。肝细胞

解析：肝、脂肪组织和小肠是合成甘油三酯的主要场所。在这些组织细胞的内质网的胞浆侧含有合成甘油三酯的酶。肝细胞能合成脂肪，但不能储存脂肪，其合成的甘油三酯主要与载脂蛋白、磷脂、胆固醇等结合形成脂蛋白，经血液运输至肝外组织利用。掌握“甘油磷脂、胆固醇和血脂蛋白代谢”知识点。